氯苯那敏可引起的不良反应是
A. 嗜睡乏力
B. 低血糖
C. 视觉异常
D. 出血
E. 骨质疏松

正确答案：A。嗜睡乏力

解析：本题考查氯苯那敏的不良反应。氯苯那敏为常用的H₁受体拮抗剂，常见不良反应有头晕、嗜睡、乏力（A对），驾驶员和高空作业者工作时间不宜使用。还可引起视物模糊、便秘、尿潴留等。